分子中含嘌呤结构，通过抑制黄嘌呤氧化酶，减少尿酸生物合成发挥作用的抗痛风药物是
A. 秋水仙碱
B. 别嘌醇
C. 丙磺舒
D. 苯海拉明
E. 对乙酰氨基酚

正确答案：B。别嘌醇

解析：本题考查别嘌呤。别嘌醇（B对）分子结构中含有嘌呤结构，通过抑制黄嘌呤氧化酶来抑制尿酸生成。秋水仙碱（A错）为一种天然产物，通过减低白细胞活动和吞噬作用及减少乳酸形成从而减少尿酸结晶的沉积，减轻炎性反应，而起止痛作用。丙磺舒（C错）抑制肾小管对水的重吸收作用，增加尿液的排泄，降低尿酸在血液中的含量，也可促进已形成的尿酸盐的溶解，无抗炎和镇痛作用，临床用于慢性痛风的治疗。苯海拉明（D错）为第一代抗组胺药物。对乙酰氨基酚（E错）为苯胺类解热镇痛药。